职业性有害因素评价工作不包括
A. 职业性有害因素接触评估与危险度评价
B. 职业病危害预评价
C. 职业病危害现状评价
D. 职业病阈限值制定
E. 职业病危害控制效果评价

正确答案：D。职业病阈限值制定

解析：本题考查职业性有害因素的评价。职业性有害因素评价工作包括：①职业病危害预评价（B对）；②职业病危害控制效果评价（E对）；③职业病危害现状评价（C对）；④职业性有害因素接触评估与危险度评价（A对）。职业病阈限值制定（D错，为本题正确答案）不是职业性有害因素的评价。